患者的权利中不包括
A. 经济免责权
B. 平等医疗权
C. 疾病认知权
D. 法律诉讼权
E. 知情同意权

正确答案：A。经济免责权

解析：患者的权利包括生命健康权、公平医疗权（B对）、医疗自主权、疾病认知权（C对）、知情同意权（E对）、隐私保护权、医疗参与和监督权、社会免责权、经济索赔权等，不包括经济免责权（A错，为本题正确答案）。